围绝经期崩漏，多属
A. 气血虚弱
B. 肾虚肝郁
C. 脾肾亏损
D. 肝郁血热
E. 肝郁脾虚

正确答案：C。脾肾亏损

解析：崩漏的主要病因为虚（脾、肾）、热、瘀，三者可单独或复合成病，又互为因果，其病机为冲任损伤，不能制约经血。崩漏病本在肾，病位在冲任、胞宫。围绝经期妇女在七七之年，肾气衰而天癸竭，经断。围绝经期经断与脾的气血生化乏源，冲脉之血衰关系密切，故围绝经期崩漏多属脾肾亏损（C对）。